女，23岁。外阴瘙痒、白带增多5天。妇科检查：外阴皮肤黏膜充血，小阴唇内侧见多个小菜花状赘生物、宫颈柱状上皮异位，子宫正常大，附件无明显异常。为确诊，应选择的辅助检查是
A. 赘生物活组织检查
B. 白带革兰染色检查
C. B超检查
D. 宫颈刮片细胞学检查
E. 血常规

正确答案：A。赘生物活组织检查

解析：该患者外阴瘙痒白带增多，外阴皮肤黏膜充血，小阴唇内侧见多个小菜花状赘生物宫颈柱状上皮异位，首先考虑为尖锐湿疣，赘生物活组织检查（A对）能够对组织进行病理学检查，确诊组织病变。白带革兰染色检查（B错）、B超检查（C错）、血常规（E错）均不能明确组织病变，故不能确诊。宫颈刮片细胞学检查（D错）可以对子宫颈癌等病变进行确诊，但不是对尖锐湿疣进行确诊，故排除之。